克罗恩病
A. 病变主要位于回盲部
B. 病变主要位于直肠和乙状结肠
C. 病变多位于回肠远段
D. 病变以全结肠弥漫性改变为主
E. 病变不可能位于空肠

正确答案：C。病变多位于回肠远段

解析：克罗恩病（Crohn病）病变主要位于回肠远端（C对），但从口腔至肛门各段消化道均可受累（E错），呈节段性或跳跃式分布。病变主要位于回盲部（A错）是肠结核的特征（P368）。病变主要位于直肠和乙状结肠（B错）是溃疡性结肠炎的特征（P374）。病变以全结肠弥漫性改变为主（D错）是溃疡性结肠炎的的特征（P374）。